兴奋-收缩偶联的结构基础是
A. 肌质网
B. 终池
C. 纵管
D. 横管
E. 三联管

正确答案：E。三联管